下列关于肉的腐败变质表述正确的是
A. 后熟的快慢只与环境温度有关
B. 肉经过僵直状态后就不新鲜了
C. 疲劳牲畜后熟过程短暂
D. 发生自溶的肉不能食用
E. 僵直状态的肉不宜直接用作烹饪原料

正确答案：E。僵直状态的肉不宜直接用作烹饪原料

解析：本题考查肉的腐败变质。肉的腐败变质经过僵直、后熟、自溶和腐败四个过程。在僵直过程中，此时的肉品一般不宜直接用作烹任原料（E对）。后熟过程与畜肉中糖原含量和外界温度有关（A错）。疲劳牲畜的肌肉中糖原少，其后熟过程延长（C错），畜肉处于僵直和后熟阶段为新鲜肉（B错）。自溶阶段的肉必须经高温处理后才可食用（D错）。